属于中枢神经系统抑制剂的是
A. 酒精
B. 可卡因
C. 海洛因
D. 丙酮
E. 仙人掌毒素

正确答案：A。酒精

解析：属于中枢神经系统抑制剂的是酒精（又称乙醇）（A对）。可卡因（B错）主要是影响递质的转运和贮存。海洛因（C错）是吗啡的衍生物，容易成瘾。丙酮（D错）是脂肪族酮类具有代表性的的化合物，具有酮类的典型反应。仙人掌毒素（E错）可麻痹神经，但不是中枢神经系统抑制剂。